与石淋的发病关系最为密切的病机是
A. 脾虚中气下陷
B. 肾虚下元不固
C. 湿热蕴结下焦
D. 热盛迫血妄行
E. 气郁化火伤阴

正确答案：C。湿热蕴结下焦

解析：脾虚中气下陷，加之膀胱气化失司，发为气淋虚证（A错）。肾虚下元不固，不能制约脂液，脂液下泄，见淋出脂汁，发为膏淋虚证（B错）。湿热蕴结下焦，尿液煎熬，结成砂石，发为石淋（C对）。湿热下注膀胱，热盛迫血妄行，发为血淋实证（D错）。气郁化火伤阴可致阴虚火旺，虚火扰络，络伤血溢，发为血淋虚证（E错）。